仅能够用于支气管哮喘急性发作的肾上腺素受体激动剂为
A. 去甲肾上腺素
B. 肾上腺素
C. 多巴胺
D. 异丙肾上腺素
E. 酚妥拉明

正确答案：B。肾上腺素

解析：肾上腺素可以控制支气管哮喘的急性发作，皮下或肌肉注射能于数分钟内奏效。由于肾上腺素严重的不良反应，仅用于急性发作者。掌握“肾上腺素”知识点。